正态分布图的说法错误的是
A. 中间高、两侧逐渐降低
B. 两侧对称
C. 接近于一条光滑的曲线
D. 图形为连接频数分布图各直条顶端的中点
E. 若将组段分细，则图中直条变宽

正确答案：E。若将组段分细，则图中直条变宽

解析：正态分布样本含量扩大，将组段分细，图中直条变窄，就会表现出中间高、两侧逐渐降低，并完全对称的特点，将频数分布图各直条顶端的中点连线，就接近于一条光滑的曲线。这条曲线就称作正态分布曲线。掌握“定量资料的统计描述和推断”知识点。